T细胞产生的细胞因子不包括
A. IL-1
B. IL-2
C. IL-3
D. IL-4
E. IL-6

正确答案：A。IL-1